一患者下颌左5678右678缺失，左下4不松动、无龋，牙槽嵴丰满。铸造支架式义齿左下4右下5远中（牙合）支托、三臂卡固位体，舌杆大连接体。义齿戴用1周后，主诉基托压痛、基牙咬合痛。口腔内检查发现：舌系带根部小溃疡，左侧下颌隆凸处黏膜红肿，左下4叩痛（+），义齿各部分密合，咬合不高。为了减轻左下4所受的扭力，可以采取以下措施，除了
A. 增加间接固位体
B. 改用RPI卡环
C. 改用回力卡环
D. 减小游离端基托
E. 人工牙减数、减径

正确答案：D。减小游离端基托

解析：本题考查减轻基牙所受扭力的措施。为了减轻左下4所受的扭力，可以采取以下措施，除了减小游离端基托（D错，为本题的正确答案）。当基牙所受扭力较大时，会造成基牙疼痛，此时应采取相应措施，将（牙合）力分散，减轻基牙所受扭力，具体措施有：1.增加间接固位体（A对），间接固位体有分散（牙合）力，减轻基牙及基托下组织承受的力的作用。2.改用RPI卡环（B对），RPI卡环可使（牙合）力作用下基牙受力减小，且作用力方向接近牙长轴。3.改用回力卡环（C对），回力卡环的（牙合）力通过人工牙和基托首先传至基托下组织，可减轻基牙承受的力，起到应力中断的作用。4.适当增大游离端基托，基托面积增大可分散（牙合）力，减轻基牙扭力。而减小游离端基托会使（牙合）力集中在基牙上，增加基牙扭力。5.人工牙减数、减径（E对），游离端缺牙排牙时可适当对人工牙进行减数、减径，以减小基牙及支持组织的（牙合）力负荷，缓解因受力过大导致的基牙疼痛。